女，25岁，刷牙出血3周就诊，检查：牙龈乳头轻度充血、水肿，牙石（+），探诊深度大多为2-3mm，未及附着丧失。此患者最可能为
A. 牙间乳头炎
B. 边缘性龈炎
C. 青春期龈炎
D. 青少年牙周炎
E. 急性坏死性龈炎

正确答案：B。边缘性龈炎

解析：本题考查慢性龈炎的临床表现。患者刷牙出血，龈乳头充血水肿，牙石（+），探诊深度2～3mm，没有附着丧失，患者的临床表现符合慢性龈炎（边缘性龈炎）（B对）的特点。牙间乳头炎（A错）表现为龈乳头发红肿胀，探触和吸吮时易出血，有自发性的胀痛和明显的探触痛。青春期龈炎（C错）好发于前牙唇侧的牙龈乳头和龈缘，唇侧牙龈肿胀明显，龈乳头常呈球状突起，颜色暗红或鲜红，光亮质软。青少年牙周炎（D错）主要发生于青春期至25岁的年轻人，病变进展快，患者20岁左右即需拨牙或牙齿自行脱落，在早期出现牙齿松动和移动，牙龈炎症轻微，但有深牙周袋形成。急性坏死性龈炎（E错）以龈乳头和龈缘的坏死为特征性损害，溃疡中央凹下如火山状，疼痛明显，坏死区有易于擦去的假膜，有典型的腐败性口臭。